问损伤下列何结构出现上述情况
A. 脊髓左侧半横断
B. 左侧内囊
C. 左侧脑桥
D. 左大脑皮质
E. 无

正确答案：B。左侧内囊

解析：一侧内囊损伤广泛时，病人会出现对侧偏身感觉丧失，对侧偏瘫，和对侧偏盲，该患者右侧肢体张力增强，腱反射亢进，右半身深感觉和浅感觉丧失，右侧视野同向性偏，为典型的右侧＂三偏＂症状，因此该患者为左侧内囊（B对）受损；脊髓左侧半横断（A错）的表现有伤平面以下，左侧肢体痉挛性瘫痪，位置觉、震动觉和精细触觉丧失，损伤节段下 1 -2 个节段平面以下的对侧痛、温觉丧失；左侧脑桥（C错）受损，主要波及附近的面神经、三叉神经、舌咽神经和迷走神经，产生相应的临床症状；左大脑皮质（D错）则与语言、意识、数学 分析等密切相关。